女，30岁，右上义齿戴后7天，咀嚼时易脱落。查：右上6缺失，可摘局部义齿，右上57三臂卡环，舌侧铸造卡环臂，颊侧为弯制卡环臂，基牙牙冠较短，颊、舌侧基托较厚，固位倒凹尚可，义齿固位差。对该患者的有效处理方法是，除外
A. 调节固位卡环臂进入倒凹区的深度
B. 改变就位道，与基牙产生制锁作用
C. 磨薄基托抛光面
D. 减小牙尖斜度
E. 增加卡环

正确答案：E。增加卡环

解析：本题考查增加义齿固位力的措施。非游离端义齿常选择在近缺隙基牙上设计固位良好的三臂正型卡环，卡环数目一般为2个（单侧），故不需要增加卡环（E错，为本题正确答案）。此患者义齿固位差，可以通过调节固位卡环臂进入倒凹区的深度（A对），将卡环臂设置在倒凹深度适宜的位置上，以此来增加固位力；还可以改变就位道，从而改变基牙倒凹的深度、坡度与制锁角的大小，充分利用与基牙产生的制锁作用（B对）来增加义齿固位力，防止义齿使用时脱落。此患者颊、舌侧基托较厚，过厚患者不舒适，可适量磨薄基托抛光面（C对）。减小牙尖斜度（D对）能减少侧向力，可增加义齿稳定性。